女，35岁，已婚。停经70天，阴道中等量流血1天。妇科检查：宫口可见组织物堵塞，子宫稍大、软，双侧附件未触及异常。应首选的处理措施是
A. 肌肉注射缩宫素治疗
B. 肌肉注射苯巴比妥
C. 保胎治疗
D. 立即行清宫术
E. 肌肉注射麦角新碱

正确答案：D。立即行清宫术

解析：中年女性患者，已婚。停经70天，阴道中等量流血1天。妇科检查：宫口可见组织物堵塞，子宫稍大、软，双侧附件未触及异常。综合患者的症状、体征和辅助检查，初步诊断为难免流产，应首选的处理措施是立即行清宫术（D对）。肌肉注射缩宫素治疗（A错）适用于引产催产、预防及治疗产后出血。肌肉注射苯巴比妥（B错）不适用于孕妇。保胎治疗（C错）适用于先兆流产。肌肉注射麦角新碱（E错）适用于产后出血、子宫复旧不良、月经过多等。